可摘局部义齿人工牙中半解剖式牙的牙尖斜度是
A. 0°
B. 10°
C. 20°
D. 30°
E. 40°

正确答案：C。20°

解析：本题考查半解剖式牙的牙尖斜度。人工牙根据人工牙面形态不同分为三种类型：解剖式牙、半解剖式牙、非解剖式牙。解剖式牙的牙尖斜度为30°-33°（D错），与初萌出的天然牙面相似。半解剖式牙的牙尖斜度为20°（C对）左右，上下颌牙间有一定尖凹扣锁关系，咀嚼效能较好，比解剖式牙的侧向力小，临床应用较广。非解剖式牙无牙尖或牙尖斜面，即牙尖斜度为0°（A错）。